中性粒细胞
A. Ab中和作用
B. 调理作用
C. 裂解细胞作用
D. ADCC
E. 引起Ⅰ型超敏反应

正确答案：B。调理作用